支气管柱状扩张的典型X线表现为
A. 蜂窝肺
B. 鼠尾征
C. 残根征
D. 树芽征
E. 轨道征

正确答案：E。轨道征

解析：支气管扩张可分为囊状扩张和柱状扩张，其中支气管囊状扩张X线典型表现为卷发状阴影；支气管柱状扩张X线典型表现纵切面为轨道征（双轨征）（E对），横切面为环形阴影，产生机制为受累肺实质通气不足、萎陷，扩张气道聚拢。蜂窝肺（A错）是多种晚期肺疾病形成以蜂窝样为特征的肺部改变。鼠尾征（B错）指支气管肺癌沿支气管的纵轴浸润蔓延，使支气管呈尾巴状狭窄且不规则的缺损。残根征（C错）为肺动脉高压时，中心肺动脉扩张和外周分支纤细的X线表现。树芽征（D错）是指病变累及细支气管时，由于炎性渗出物或分泌物堵塞细支气管的表现。